毛细淋巴管叙述错误的是
A. 常与毛细血管伴行
B. 有瓣膜
C. 管腔粗细均匀
D. 管壁为单层内皮细胞
E. 管壁通透性大于毛细血管

正确答案：C。管腔粗细均匀

解析：淋巴管由毛细淋巴管汇合而成，管壁为单层内皮细胞（D对），基膜不完整，可通过蛋白质碎片、脂类等，所以通透性大于毛细血管（E对），淋巴管有瓣膜（B对），防止淋巴逆流，相邻两瓣膜之间扩张明显，所以淋巴管管道不均匀（C错，为本题正确答案）。